一青年近3日咳嗽，高热39℃，咳铁锈色痰，WBC18.5×10⁹/L，X线胸片发现右肺中叶有大片阴影，临床诊断为大叶性肺炎，请问致病菌是
A. 嗜肺军团菌
B. 肺炎链球菌
C. 肺炎克雷伯菌
D. 肺炎支原体
E. 肺炎衣原体

正确答案：B。肺炎链球菌